具有燥湿祛风、杀虫止痒功效的药物是
A. 炉甘石
B. 赤石脂
C. 麻黄根
D. 蛇床子
E. 肉豆蔻

正确答案：D。蛇床子

解析：蛇床子是攻毒杀虫止痒药，辛苦温燥，有燥湿祛风，杀虫止痒之功（D对），为皮肤病及妇科病常用药。炉甘石为拔毒化腐生肌药，有收湿止痒之功，为眼科外用之常用药，不可杀虫（A错）。赤石脂、肉豆蔻、麻黄根均为收涩药，赤石脂、肉豆蔻可涩肠止泻，三者皆无燥湿祛风、杀虫止痒之功（BCE错）。